制订日平均最高容许浓度的目的是防止
A. 出现刺激、过敏或慢性中毒
B. 发生慢性中毒或蓄积现象及远期效应
C. 出现过敏、刺激或中毒等急性危害
D. 发生致癌作用
E. 发生“三致”作用

正确答案：B。发生慢性中毒或蓄积现象及远期效应

解析：本题考查制订日平均最高容许浓度的目的。日平均最高容许浓度是指任何一个自然日平均浓度的最高容许值。制订日平均最高容许浓度的目的是防止发生慢性中毒或蓄积现象及远期效应（B对ACDE错）。